某患者，竞争意识强，总想胜过他人，老觉得时间不够用，说话快、走路快;脾气暴躁，容易激动，常与他入的意见不一致。其行为类型属于
A. A型
B. B型
C. C型
D. AB混合型
E. BC混合型

正确答案：A。A型

解析：A型（A对）人格者属于较具进取心、侵略性、自信心、成就感，并且容易紧张。A型人格者总愿意从事高强度的竞争活动，不断驱动自己要在最短的时间里干最多的事，并对阻碍自己努力的其他人或其他事进行攻击。B型（B错）人格者则属较松散、与世无争，对任何事皆处之泰然。C型（C错）性格指那种情绪受压抑的抑郁性格，表现为害怕竞争，逆来顺受，有气往肚子里咽，爱生闷气的性格。